根据《药品流通监督管理办法》，药品经营企业的药品销售凭证应当
A. 保存3年或以上
B. 保存5年
C. 保存至超过药品有效期1年，但不少于2年
D. 保存至超过药品有效期1年，但不少于3年
E. 保存至超过药品有效期1年，但不少于5年

正确答案：E。保存至超过药品有效期1年，但不少于5年

解析：本题考查的是药品批发的经营行为管理要求。根据《药品流通监督管理办法》，药品经营企业的药品销售凭证应当保存至超过药品有效期1年，但不少于5年（E对）。药品批发企业购进药品，应当建立并执行进货检查验收制度，索取、查验、留存《药品经营监督管理办法》规定的供货企业及其授权委托销售人员有关证件资料、销售凭证（保存至超过药品有效期1年，且不得少于5年），在验明药品合格证明和其他标识等证明药品合法性材料后方可购进、销售；不符合规定的，不得购进和销售。